早期胃癌是指
A. 侵及黏膜下层及肌层的癌
B. 直径小于2cm的癌
C. 无局部淋巴结转移的癌
D. 癌灶局限于黏膜层及黏膜下层
E. 无临床症状的癌

正确答案：D。癌灶局限于黏膜层及黏膜下层

解析：早期胃癌指病变仅限于黏膜或黏膜下层，不论病灶大小或有无淋巴结转移（D对ABCE错）。